阴盛格阳的证候是
A. 真热假寒证
B. 真寒假热证
C. 实寒证
D. 实热证
E. 寒热错杂证

正确答案：B。真寒假热证

解析：阴盛格阳，指阳气极虚，导致阴寒之气偏盛，壅闭于里，逼迫阳气浮越于外，而出现内真寒外假热的病机变化（B对）；阳盛格阴，指阳气偏盛至极，壅遏于内，排斥阴气于外，而出现内真热外假寒的病机变化（A错）；阴偏盛的病机特点为阴盛而阳未虚，临床表现为实寒证为主（C错）；阳偏盛的病机特点未阳盛而阴未虚，临床表现为实热证为主（D错）；寒热错杂证是指在同一病人身上同时出现寒证和热证，呈现寒热交错的现象（E错）。